单纯性甲状腺肿的甲状腺功能表现是
A. FT4正常、FT3正常、TSH正常
B. FT4正常、FT3正常、TSH减低
C. FT4减低、FT3减低、TSH减低
D. FT4减低、FT3减低、TSH增高
E. FT4减低、FT3减低、TSH正常

正确答案：A。FT4正常、FT3正常、TSH正常

解析：单纯性甲状腺肿多数甲状腺功能正常。故答案选择FT4正常、FT3正常、TSH正常（A对）。